下列诸肌中，何者一侧收缩时，使舌尖伸向对侧
A. 颏舌肌
B. 舌骨舌肌
C. 茎突舌肌
D. 舌横肌
E. 舌纵肌

正确答案：A。颏舌肌

解析：颏舌肌(A对)单侧收缩可使舌尖伸向对侧，舌骨舌肌(B错)收缩可引舌向后下，茎突舌肌(C错)收缩可引舌向后上，舌横肌(D错)收缩可使舌变窄变厚，舌纵肌(E错)收缩可使舌变短卷曲。